具有类肾上腺皮质激素作用，能够通过抗炎保护肝脏的药物是
A. 硫普罗宁
B. 复方氨基酸
C. 双环醇
D. 异甘草酸镁
E. 腺苷蛋氨酸

正确答案：D。异甘草酸镁